患儿l0岁，前牙冷刺激疼数日。检查：右上中切牙近中深龋洞，叩诊无异常，不松动，冷测一过性痛。处理：去腐干净极近髓，敏感。选何种治疗方法
A. 二次去腐
B. 氧化锌丁香油糊剂安抚
C. 氢氧化钙间接盖髓
D. 直接盖髓
E. 活髓切断

正确答案：B。氧化锌丁香油糊剂安抚

解析：该患者处理时，已去腐干净，不需二次去腐（A错）。有深龋洞，冷测一过性敏感，备洞过程中敏感，应先进行安抚治疗，待牙髓充血症状缓解之后再行永久充填（B对）。氢氧化钙间接盖髓用于软化牙本质不能一次去净，牙髓-牙本质反应能力下降，无明显主观症状的深龋（C错）。直接盖髓适用于机械性或外伤性露髓的患牙（D错）。活髓切端术适用于龋源性、外伤性或机械性露髓的年轻恒牙（E对）。